四时阴阳的消长变化，从冬至到立春为
A. 阴消阳长
B. 重阴必阳
C. 阴长阳消
D. 重阳必阴
E. 由阳转阴

正确答案：A。阴消阳长

解析：本题考查四时阴阳的消长变化，属于理解记忆内容。从冬至到立春，阳气逐渐上升，阴气逐渐下降，是阴消阳长的表现（A对BCDE错）。